下列属于营养必需脂肪酸的是
A. 软脂酸
B. 亚麻酸
C. 硬脂酸
D. 油酸
E. 月桂酸

正确答案：B。亚麻酸

解析：人体营养必需脂肪酸有亚油酸、α-亚麻酸（B对）和花生四烯酸。软脂酸（A错）、硬脂酸（C错）、油酸（D错）、十二碳酸脂肪酸（E错）均为非必需脂肪酸。